下列可出现苔藓样变的疾病是
A. 带状疱疹
B. 银屑病
C. 急性湿疹
D. 慢性湿疹
E. 亚急性湿疹

正确答案：D。慢性湿疹

解析：慢性湿疹患部皮肤肥厚，表皮粗糙，呈苔藓样变（D对）。带状疱疹诊断要点：根据成簇水疱，单侧沿神经走向分布伴有明显的神经疼痛（A错）。银屑病基本皮损为红斑、丘疹或斑块上附有白色鳞屑（B错）。急性湿疹具有多形性、渗出性、瘙痒性、对称性（C错）。亚急性湿疹皮损主要表现为红肿、渗出等急性炎症减轻，皮损呈暗红色，水疱和糜烂逐渐愈合，渗出减少，可有丘疹，少量丘疱疹及鳞屑，皮损呈轻度浸润（E错）。